威灵仙的原植物有
A. 铁线莲
B. 威灵仙
C. 东北铁线莲
D. 柱果铁线莲
E. 棉团铁线莲

正确答案：B、C、E。威灵仙；东北铁线莲；棉团铁线莲